下列属于乙类传染病，但是采取甲类传染病的预防、控制措施的是
A. 艾滋病
B. 人感染高致病性禽流感
C. 流行性出血热
D. 登革热
E. 血吸虫病

正确答案：B。人感染高致病性禽流感

解析：除甲类传染病外，《传染病防治法》规定，对乙类传染病中传染性非典型肺炎、炭疽中的肺炭疽和人感染高致病性禽流感，采取传染病防治法所称甲类传染病的预防、控制措施。其他乙类传染病和突发原因不明的传染病需要采取传染病防治法所称甲类传染病的预防、控制措施的，由国务院卫生行政部门及时报经国务院批准后予以公布、实施。2009年4月30日，卫生部经国务院批准，将甲型H1N1流感纳入乙类传染病，并采取甲类传染病的预防、控制措施。掌握“传染病的概述”知识点。